丙氨酸氨基转移酶和天门冬氨酸氨基转移酶共同底物是
A. 天冬酰胺
B. 谷氨酸
C. 谷氨酰胺
D. 酪氨酸
E. 精氨酸

正确答案：C。谷氨酰胺